下列关于五脏外合五体的叙述，错误的是
A. 心合脉
B. 肝合爪
C. 脾合肉
D. 肺合皮
E. 肾合骨

正确答案：B。肝合爪

解析：本题考查五脏与五体的关系，属记忆内容。心在体合脉，是指全身的血脉统属于心，由心主司（A对）。肺与皮毛相合，是指肺与皮毛的相互为用关系（D对）。脾在体合肉，是指脾气的运化功能与肌肉的壮实及其功能发挥之间有着密切的联系（C对）。肝血充足则筋力强健，运动灵活，能耐受疲劳，并能较快的解除疲劳，如果肝血亏虚，筋脉得不到很好的濡养，则筋的运动能力就会减退（B错，为本题正确答案）。肾主骨生髓（E对）。